认为人的心理与生理精神与躯体机体内外环境是一个完整的统一体属于
A. 神灵主义医学模式
B. 自然哲学医学模式
C. 机械论医学模式
D. 生物医学模式
E. 生物-心理-社会医学模式

正确答案：E。生物-心理-社会医学模式

解析：生物-心理-社会医学模式是从整体、系统的角度认识人类健康与疾病，认为影响人类健康的主要因素包括生物因素、环境因素、行为和生活方式及卫生服务等因素，并以此为依据探求维护健康的全方位的手段（E对）。神灵主义医学模式是指把患病的原因归咎于某种超自然的神秘力量的医学理论，以及以占卜、祭祀、祈祷等为主要医学手段的医学实践方式（A错）。自然哲学医学模式就是用朴素的辩证法和唯物主义的观点解释疾病的病因病机，以直观的自然现象说明生理病理过程，并通过调节情志、搭配用药，促进身心健康的一种整体医学观（B错）。机械论唯物论医学模式是一种用机械运动解释生命，把疾病比作机械故障，把治疗疾病比拟为维修机器，以机械论的观点和方法来观察和解决健康与疾病问题的医学模式（C错）。生物医学模式是指一种把人看作单纯的生物或生物机器，把疾病看成是生物机制紊乱导致的、可以在器官、细胞或生物大分子上寻找形态和生物化学上的变化并确诊疾病、可以用手术、药物、理疗等方法改变病理变化的医学观（D错）。